面色苍白，时而泛红如妆，其证型是
A. 实热内炽
B. 阴虚火旺
C. 肝胆湿热
D. 真寒假热
E. 真热假寒

正确答案：D。真寒假热

解析：“戴阳”指阳气因下焦虚寒而浮越于上，出现下真寒而上假热的证候。患者见呼吸迫促，气短，倦怠懒言，上气不接下气，足冷等为真寒的表现。假热的症状可见面色浮红，口鼻有时出血，口燥齿浮，脉浮大，按之空虚无力（D对）。实热内炽（A错），因热性炎上，血行加速而充盈于面，可见于脏腑火热炽盛或外感邪热亢盛患者，表现为满面通红、目赤。患者午后两颧潮红，为虚热证，因阴虚火旺（B错），虚火上炎所致，可见于内伤久病，如肺痨病等。面目一身俱黄者，称为黄疸。其中湿热蕴结肝胆（C错）所致者，黄而鲜明如橘皮色，称为阳黄。真热假寒（D错），指内有真热而外见某些假寒的症候。阳热内盛，格阴于外，阳气内闭而不能布达四末。故其虽有外部似为阴寒证的表现如：四肢凉甚至厥冷，恶寒甚，面色紫暗等，但其本质为热，也有四肢冷而胸腹灼热，口鼻气灼，口臭息粗，口渴引饮，小便短赤，大便燥结等实热证的表现。